阴茎根
A. 包括两侧阴茎脚及尿道球
B. 背侧借阴茎悬韧带悬于耻骨联合前面
C. 借阴茎脚附于耻骨支和坐骨支上
D. 借尿道球固定于尿生殖膈下筋膜
E. 上述全部正确

正确答案：E。上述全部正确

解析：阴茎根包括两侧阴茎脚及尿道球。背侧借阴茎悬韧带悬于耻骨联合前面。借阴茎脚附于耻骨支和坐骨支上。借尿道球固定于尿生殖膈下筋膜（ABCD对，故E为本题正确答案）。